女，65岁。食用坚果后突发呕血4小时，伴心悸、胸闷、气短。既往慢性乙型肝炎病史20年，冠心病病史8年。查体：T36.5C,P110次/分，R24次/分，BP90/50mmHg，双肺呼吸音清，未闻及干湿性啰音心率不齐，可闻及早博10次/分，腹软，无压痛。最适合的治疗药物是
A. 西咪替丁
B. 硝酸甘油
C. 血管加压素
D. 普萘洛尔
E. 生长抑素

正确答案：E。生长抑素

解析：老年患者，既往乙肝病史、冠心病史，食用坚果后突发呕血，伴心悸、胸闷、气短，查体：T36.5℃（正常值为36℃～37℃），P110次/分（正常值为60～100次/分，提示心率增快），R24次/分（正常值为16～20次/分，提示呼吸增快），BP90/50mmHg（正常值为90～140/60～90mmHg，提示血压降低），心率不齐，可闻及早早搏10次/分，腹软，无压痛，根据患者的既往病史、临床症状及体征，考虑最可能的诊断为食管胃底静脉曲张出血伴休克，最适合的治疗药物是生长抑素（E对），该药对全身血流动力学影响较小，不良反应少，是治疗食管胃底静脉曲张出血最常用的药物。